医疗机构从批发企业购进药品应验明是否具有
A. 药品注册商标
B. 药品批准文号
C. 《药品生产许可证》
D. 《药品经营许可证》
E. 《医疗机构制剂许可证》

正确答案：D。《药品经营许可证》

解析：《药品管理法》规定，无《药品经营许可证》的，不得经营药品（D对）。药品注册商标是为了保证药品质量，保障人民身体健康，维护药品生产企业和药品经营企业的正当利益，根据《药品管理法》和《商标法》的规定，除中药材、中药饮片外，药品必须使用注册商标；未经核准注册的，不得在市场销售（A错）。生产新药或者已有国家标准的药品的，须经国务院药品监督管理部门批准，并在批准文件上规定该药品的专有编号，此编号称为药品批准文号（B错）。《药品生产许可证》用于药品生产企业（C错）。医疗机构配制制剂应取得的合法证件是《医疗机构制剂许可证》（E错）。